复发性口腔溃疡的治疗措施中，近期疗效最佳的是
A. 口腔局部消炎，止痛、促愈合
B. 手术切除
C. 注射转移因子或口服左旋咪唑
D. 针对与发病有关的全身和局部因素治疗
E. 补充营养

正确答案：C。注射转移因子或口服左旋咪唑

解析：本题考查对复发性口腔溃疡近期疗效最佳的治疗。转移因子是一种免疫增强剂，有激发机体免疫系统产生免疫应答的作用，可促进溃疡愈合，左旋咪唑可提高病人对于细菌及病毒感染的抵抗力，也可加速溃疡的愈合，因此注射转移因子或口服左旋咪唑对复发性口腔溃疡近期疗效最佳（C对）。口腔局部消炎，止痛、促愈合（A错）是改善复发性口腔溃疡症状的有效方法，但并不是近期疗效最佳的方法。手术切除（B错）对于复发性口腔溃疡没必要。针对与发病有关的全身和局部因素治疗（D错）属于根治性治疗口腔复发性溃疡，减少复发的方法。补充营养（E错）属于支持治疗，复发性口腔溃疡一般不需要支持治疗。